卡介苗属于
A. 灭活疫苗
B. 减毒活疫苗
C. 类毒素疫苗
D. 基因工程疫苗
E. DNA疫苗

正确答案：B。减毒活疫苗